下述检査对区分上下尿路感染没有意义的是
A. 尿白细胞管型
B. B超示肾盂形态异常
C. 膀胱穿刺培养示大肠杆菌
D. 肾区叩痛
E. 外周血WBC明显升高

正确答案：C。膀胱穿刺培养示大肠杆菌

解析：膀胱穿刺培养示大肠杆菌（C错，为本题正确答案）只能证明尿路存在感染，上、下尿路感染膀胱穿刺培养均可示大肠杆菌，因此，其对区分上下尿路感染没有意义。尿白细胞管型（A对）、B超示肾盂形态异常（B对）、外周血WBC明显升高（E对）及肾区叩痛（D对）均可见于上尿路感染，而不会出现在下尿路感染中，因此其具有鉴别意义。